在临床中发现的遗传性牙本质发育不全中，乳牙受累较恒牙更严重的是哪一型
A. DGI-Ⅰ
B. DGI-Ⅱ
C. DGI-Ⅲ
D. DGI-Ⅳ
E. DGI-Ⅴ

正确答案：A。DGI-Ⅰ

解析：受累牙列三种类型疾病的牙齿临床表现差异很大，一般DGI-Ⅰ型的乳牙受累较恒牙更严重。掌握“遗传性牙本质发育不全”知识点。